妊娠期高血压疾病的诊断方面，下述哪项是正确的
A. 妊娠后期血压有一次在17.3/12kPa（130/90mmHg）以上
B. 高血压、水肿、蛋白尿三者具备，为中度妊高征
C. 重度妊高征血压必须在24/14kPa（180/110mmHg）
D. 子痫一般有前驱症状
E. 妊娠期高血压疾病大多有后遗症

正确答案：D。子痫一般有前驱症状

解析：A项妊娠后期血压有一次在17.3/12kPa（130/90mmHg）以上：显然是错误的。B项高血压、水肿、蛋白尿三者具备，为中度妊高征：轻度妊高征时就已经具备。C项重度妊高征血压必须在24/14kPa（180/110mmHg）：重度妊高征血压≥160/100mmHg，尿蛋白++～++++；24小时尿蛋白≥5g；可有不同程度的水肿，伴有自觉症状。D项子痫一般有前驱症状：除高血压及蛋白尿外，出现头痛、眼花、恶心、胃区疼痛及呕吐等症状。E项妊娠期高血压疾病一般没有后遗症，症状在分娩后即随之消失。掌握“娠期高血压疾病”知识点。